氨苄西林临床作用正确的是
A. 伤寒
B. 尿路感染
C. 呼吸道感染
D. 胃肠道感染
E. 以上说法均正确

正确答案：E。以上说法均正确

解析：氨苄西林临床用于治疗敏感菌所致的呼吸道感染、伤寒、副伤寒、尿路感染、胃肠道感染、软组织感染、脑膜炎、败血症、心内膜炎等。掌握“青霉素及头孢菌素类药”知识点。